《素问·四气调神大论》冬季应：“早卧晚起，以待阳光”是指下列哪项养生目的
A. 有利预防春季温病
B. 有利气血旺盛
C. 有利蓄养阴精
D. 有利阳气潜藏，阴精积蓄，避寒保温
E. 有利心神宁静

正确答案：D。有利阳气潜藏，阴精积蓄，避寒保温

解析：“早卧晚起，以待日光”，即较早睡觉，待早晨太阳出来之后再起床，早睡可以保养人体阳气，晚起可滋养人体阴气，如此延长睡眠的时间，减少剧烈活动，才能起到收藏能量的效果（D对ABCE错）。